大豆中的抗营养因素中能影响钙、铁、锌等矿物元素吸收的是
A. 水苏糖
B. 棉籽糖
C. 植酸
D. 植物红细胞凝集素
E. 皂苷

正确答案：C。植酸